下列属于肝药酶诱导剂的是
A. 西咪替丁
B. 罗红霉素
C. 甲硝唑
D. 利福平
E. 胺碘酮

正确答案：D。利福平

解析：本题考查酶的诱导与抑制。肝药酶诱导剂药物有利福平（D对）、苯巴比妥、水合氯醛、甲丙氨酯、苯妥英钠、扑米酮、卡马西平、尼可刹米等。肝药酶抑制剂药物有氯霉素、西咪替丁（A错）、异烟肼、胺碘酮（E错）、红霉素（B错）、甲硝唑（C错）等。